患者，男，18岁。突然出现无痛性腹泻，米泔水样便，量多，大便频繁，继之出现喷射状呕吐，呕吐物为米泔水样。查体：神志淡漠，声音嘶哑，眼窝深凹，口唇干燥。应首先考虑的是
A. 霍乱
B. 急性细菌性痢疾
C. 急性胃肠炎
D. 伤寒
E. 副伤寒

正确答案：A。霍乱

解析：患者为无痛性腹泻，米泔水样便，喷射状呕吐，且伴有声音嘶哑，眼窝深凹，口唇干燥等脱水症状，故应首先考虑的是霍乱（A对）。急性细菌性痢疾（B错）好发于夏秋季节，，多表现为发热、腹痛、腹泻、里急后重、排黏液脓血便等，本例患者为无痛性腹泻，且大便性状与之不符，故不考虑急性细菌性痢疾可能。急性胃肠炎（C错）临床表现主要为恶心、呕吐、腹痛、腹泻、发热等，亦常见于夏秋季，大便每日数次至数十次，轻型腹泻大便为黄色或黄绿色，少量粘液或白色皂块，较重的腹泻可为大量水样便，少量粘液；本例患者为无痛性腹泻，故不考虑该诊断。伤寒（D错）临床表现为持续性发热、表情淡漠、相对缓脉、玫瑰疹、肝脾肿大及白细胞减少等，本例患者临床表现与之不符，无相对缓脉、玫瑰疹、白细胞计数减少等伤寒的典型表现，故不考虑该诊断。副伤寒（E错）的胃肠炎型主要以发热、恶心、呕吐、腹痛、腹泻等胃肠炎症状为主，本例患者为无痛性腹泻，故不考虑该诊断。